不能用于6岁以下儿童的疫苗是
A. 亚单位疫苗
B. 裂解疫苗
C. 全病毒灭活疫苗
D. 减毒活疫苗
E. 流感病毒基因工程疫苗

正确答案：C。全病毒灭活疫苗

解析：本题考查流感病毒的疫苗种类。流感全病毒灭活疫苗（C错，为本题正确答案）具有较高的免疫原性和相对较低的生产成本，但是在接种过程中不良反应发生率较高，不适用于6岁以下儿童。亚单位疫苗（A对）、裂解疫苗（B对）、减毒活疫苗（D对）和流感病毒基因工程疫苗（E对）均可用于6岁以下儿童。